不宜用金-瓷冠修复的是
A. 锥形牙
B. 错位前牙
C. 活髓牙
D. 青少年恒牙
E. 四环素牙

正确答案：D。青少年恒牙

解析：本题考查烤瓷熔附金属冠。青少年的年轻恒牙（D错，为本题正确答案）髓角高、髓腔大，牙体预备时容易意外露髓，所以不适合制作金属烤瓷全冠。